杀灭物品上的一切致病和非致病微生物的是
A. 手工清洗
B. 清洗机清洗
C. 超声波清洗
D. 消毒
E. 灭菌

正确答案：E。灭菌

解析：指杀灭物品上的一切致病和非致病微生物，包括芽胞，使之达到无菌程度。经过灭菌的物品称为“无菌物品”。掌握“口腔器械的消毒与灭菌及医疗废物处理”知识点。